关于脑神经进出脑的部位描述中，正确的是
A. 中脑脚间窝内有视神经
B. 小脑中脚有展神经
C. 延髓锥体前方有舌下神经
D. 脑桥延髓沟外侧部有面神经
E. 脑桥背面有动眼神经

正确答案：D。脑桥延髓沟外侧部有面神经

解析：面神经经脑桥延髓沟外侧部进出脑（D对）。视神经经视神经管进脑（A错）。展神经经脑桥延髓沟中线两侧出脑（B错）。舌下神经经延髓锥体与位于后外侧的橄榄体之间出脑（C错）。动眼神经经中脑脚间窝出脑（E错）。